形成尿液的器官是
A. 肾
B. 输尿管
C. 膀胱
D. 尿道
E. 以上均不是

正确答案：A。肾

解析：形成尿液的器官是肾（A对）。输尿管是输送尿液的器官（B错），膀胱为储存尿液的器官（C错），尿道是排出尿液的器官（D错）。